需要进行治疗药物监测的情况是
A. 应用头孢拉定治疗扁桃体炎
B. 应用氨氯地平治疗高血压
C. 应用地高辛治疗心力衰竭
D. 应用格列吡嗪治疗糖尿病
E. 应用对乙酰氨基酚治疗发热

正确答案：C。应用地高辛治疗心力衰竭

解析：本题考查地高辛。地高辛（C对）安全范围小，易中毒，因此要进行治疗药物监测。头孢拉定（A错）、氨氯地平（B错）、格列吡嗪（D错）、对乙酰氨基酚（E错）血药浓度安全范围广，毒性较小，因此不用进行治疗药物监测。